常把降水作为生活饮用水水源的地区是
A. 热带雨林
B. 山区
C. 岛屿
D. 高原
E. 盆地

正确答案：C。岛屿

解析：本题考查常把降水作为生活饮用水水源的地区。降水是指雨、雪、雹水，水质较好、矿物质含量较低，但水量无保证。如果大气环境质量优良，相应降水质量也好，海洋中的一些岛屿（C对ABDE错）把降水直接作为饮用水。